真核细胞核糖体的沉降系数为
A. 50S
B. 60S
C. 70S
D. 80S
E. 90S

正确答案：D。80S

解析：真核细胞核糖体的沉降系数为80S，也是由大小两个亚基构成。40S小亚基含18SrRNA及30多种蛋白质，60S大亚基含3种rRNA（28S，5.8S，5S）以及大约45种蛋白质。核糖体的这些rRNA以及蛋白质折叠成特定的结构，并具有许多短的双螺旋区域。掌握“RNA”知识点。